人工干燥饮片时，干燥温度应视药物性质而定，一般药物的干燥温度不宜超过
A. 40℃
B. 50℃
C. 60℃
D. 80℃
E. 70℃

正确答案：D。80℃

解析：本题考查的是饮片的干燥方法。人工干燥饮片时，干燥温度应视药物性质而定，一般药物的干燥温度不宜超过80℃（D对）。一般药物以不超过80℃为宜。含芳香挥发性成分的饮片以不超过50℃（B错）为宜。